决定肺内气体交换方向的主要因素是
A. 气体的分压差
B. 气体的溶解度
C. 气体的分子量
D. 气体的扩散系数
E. 呼吸膜的通透性

正确答案：A。气体的分压差